骨巨细胞瘤特征性X线片变化
A. 脊椎呈“竹节”样
B. 骨膜反应呈三角形
C. 骨端膨胀呈肥皂泡样
D. 长管骨干骺区有骨性疣状突起
E. 有死骨形成并有包壳

正确答案：C。骨端膨胀呈肥皂泡样

解析：骨巨细胞瘤的特征性X线片变化为骨端膨胀呈肥皂泡样改变（C对）。脊椎呈“竹节”样（P765）（A错）为强直性脊柱炎的特征性表现。骨膜反应呈三角形（P777）（B错）为骨肉瘤的特征性表现。长管骨干骺区有骨性疣状突起（P774）（D错）为骨软骨瘤的特征性表现。有死骨形成并有包壳（P742）（E错）为慢性血源性骨髓炎的特征性表现。